脊髓突然被横断后，断面以下脊髓所支配的骨骼肌的紧张度
A. 增强，但能恢复正常
B. 降低，能恢复但与正常不同
C. 降低，但能恢复正常
D. 增强，但不能恢复正常
E. 基本不变

正确答案：B。降低，能恢复但与正常不同